大肠液亏证的主症是
A. 口干咽燥
B. 口臭头晕
C. 便干难以排出
D. 舌红苔白干
E. 脉象细涩

正确答案：C。便干难以排出

解析：肠燥津亏证因肠道津液亏少，肠失濡润，传导失职，主要表现为大便干燥，状如羊屎，数日一行，腹胀作痛，或见左少腹包块（C对）；还兼有津亏症状，如口干（A错），或口臭，或头晕（B错），舌红少津，苔黄燥（D错），脉细涩（E错）。